诊断急性胰腺炎最广泛应用的化验指标是
A. 血清淀粉酶
B. 血清淀粉酶的同工酶
C. 血糖
D. 血清脂肪酶
E. 血清钙

正确答案：A。血清淀粉酶